一种新治疗方法可以延长寿命，但不能治愈该病则会出现
A. 该病患病率将降低
B. 该病发病率将升高
C. 该病发病率将降低
D. 该病患病率将升高
E. 该病发病率和患病率均会降低

正确答案：D。该病患病率将升高

解析：本题考查引起患病率升高的因素。引起患病率升高（D对ABCE错）的主要因素包括：①新病例增加；②治疗水平提高，病人免于死亡，但未痊愈，病程延长；③未治愈者的寿命延长；④病例迁入；⑤健康者迁出；⑥易感者迁入；⑦诊断水平提高；⑧报告率提高。